干大豆中含量高达35%～40%的营养素是
A. 蛋白质
B. 脂肪
C. 淀粉
D. 膳食纤维
E. 维生素C

正确答案：A。蛋白质

解析：本题考查干大豆中含量高达35%～40%的营养素。干大豆中含量高达35%～40%的营养素是蛋白质（A对BCDE错）。